引发猩红热的病原体是
A. 葡萄球菌
B. 链球菌
C. 肺炎链球菌
D. 脑膜炎奈瑟菌
E. 淋病奈瑟菌

正确答案：B。链球菌

解析：引发猩红热的病原体是链球菌（A组β型链球菌）（B对）。葡萄球菌（A错）易于引起化脓性疾病，如皮肤化脓感染、各种器官以及全身感染，也会引起毒素性疾病，如食物中毒、烫伤样皮肤综合征、毒性休克综合征等。肺炎链球菌（C错）主要引起大叶肺炎、脑膜炎、支气管炎等（P99）。脑膜炎奈瑟菌（D错）主要引起化脓性脑膜炎，即流行性脑脊髓膜炎（P105）。淋病奈瑟菌（E错）引起人类泌尿生殖系统黏膜化脓性感染（淋病）（P105）。